关于法莫替丁用药注意事项的说法，错误的是
A. 以原形从肾脏排泄，肾功能不全患者易造成药物在体内蓄积
B. 抑制肝脏细胞色素P450酶的活性，从而影响茶碱、华法林、地西泮等药物的代谢
C. 肾功能不全患者需要减少给药剂量或延长给药间隔
D. 与西咪替丁相比对性激素的影响较轻
E. 妊娠期、哺乳期妇女禁用

正确答案：B。抑制肝脏细胞色素P450酶的活性，从而影响茶碱、华法林、地西泮等药物的代谢

解析：本题考查法莫替丁用药注意事项。服用法莫替丁的注意事项有：1.不与肝脏细胞色素P450酶作用，故不影响茶碱、苯妥英、华法林及地西泮等药物的代谢（B错，为本题正确答案）；2.法莫替丁以原形从肾脏排泄，肾功能不全患者易造成药物在体内蓄积（A对），严重肾功能不全者禁用；3.不良反应：少数患者可有口干、头晕、失眠、便秘、腹泻、皮疹、面部潮红、白细胞减少；4.妊娠期、哺乳期妇女禁用（E对）；5.本药主要是通过肾脏排泄的，因高龄者常有肾功能减退的现象，会出现血中浓度蓄积，所以，要减少给药量或延长给药间隔（C对）。法莫替丁比西咪替丁对性激素影响轻（D对）。